在《中国药典》中，硫酸庆大霉素的含量测定方法是
A. 非水溶液滴定法
B. 紫外-可见分光光度法
C. 高效液相色谱法
D. 气相色谱法
E. 抗生素微生物检定法

正确答案：E。抗生素微生物检定法

解析：本题考查硫酸庆大霉素的含量测定方法。在《中国药典》中，硫酸庆大霉素的含量测定方法是抗生素微生物检定法（E对）。